张某打国家计划疫苗后出现严重残疾，疫苗无问题，操作无问题，进行赔偿的是什么部门
A. 国家国务院
B. 疫苗厂商
C. 张某单位
D. 省财政部门
E. 当地卫生部门

正确答案：D。省财政部门

解析：预防接种异常反应的补偿：（疫苗流通知预防接种管理条例）规定，因预防接种异常反应造成受众者死亡、严重残疾或者器官组织损伤的，应当给予一次性补偿。因接种第一类疫苗引起预防接种异常反应，需要对受众者予以补偿的补偿费用。由省、自治区、直辖市人民政府财政部门在预防接种工作经费中安排。因接种第二类疫苗引起预防接种异常反应需要对受众者予以补偿的，补偿费用由相关的疫苗生产企业承担。国家鼓励建立通过商业保险等形式对预防接种异常反应受众者予以补偿的机制（D对）。